继发性腹膜炎最突出的腹痛特点是
A. 疼痛程度随时间变化
B. 腹痛范围有大小变化
C. 原发病灶处疼痛最显著
D. 疼痛呈阵发性加剧
E. 肛门排便、排气后腹痛可缓解

正确答案：C。原发病灶处疼痛最显著

解析：急性弥漫性腹膜炎分为原发性腹膜炎和继发性腹膜炎，以继发性腹膜炎最常见。腹膜炎最典型的体征为腹部压痛、腹肌紧张、反跳痛，尤以原发病灶所在部位最明显（C对）。腹膜炎腹痛一般都很剧烈，呈持续性（AD错），先从原发病变部位开始，随炎症扩散而延及全腹，但腹痛范围有大小变化（B错）不是最突出特点。肛门排便、排气后腹痛可缓解（E错）一般为肠梗阻的临床特点。